治疗地高辛中毒引起的窦性心动过缓和传导阻滞的药物是
A. 地高辛抗体
B. 考来烯胺
C. 氢氯噻嗪
D. 阿托品
E. 苯妥英钠

正确答案：D。阿托品

解析：本题考查强心苷中毒解救药。阿托品（D对）为M胆碱受体阻断剂，可阻断心肌M胆碱受体，抑制传出神经对心脏的抑制作用。可用于治疗强心苷引起的房室传导阻滞、窦性心动过缓、窦性停搏等。地高辛抗体（A错）用于地高辛中毒解救。考来烯胺（B错）可治疗洋地黄中毒。氢氯噻嗪（C错）为常用的利尿剂。苯妥英钠（E错）可用于强心苷引起的室性心律失常。